男，35岁。牙龈出血、皮肤淤斑，间断鼻出血10天，既往体健。血常规：Hb64g/L，WBC10.5×10⁹/L，Plt26×10⁹/L。骨髓细胞学检查：增生明显活跃，胞浆中较多颗粒且MPO染色强阳性的细胞占0.65，其中有的可见成堆Auer小体，若进行流式细胞术检查，此
A. CD14阳性、HLA-DR阳性
B. CD41阳性、CD19阳性
C. CD10阳性、CD19阳性
D. CD13阳性、HLA-DR阳性
E. CD33阳性、HLA-DR阴性

正确答案：E。CD33阳性、HLA-DR阴性

解析：中年男性患者，牙龈出血、皮肤淤斑，间断鼻出血10天，既往体健。血常规：Hb64g/L（男性正常值为120～160g/L），WBC10.5×10⁹/L（正常值为4～10×10⁹/L），Plt26×10⁹/L（正常值为100～300×10⁹/L）。骨髓细胞学检查：增生明显活跃，胞浆中较多颗粒且MPO（髓过氧化物酶）染色强阳性的细胞占0.65，其中有的可见成堆Auer小体，综合患者的症状、体征和辅助检查，初步诊断为急性早幼粒细胞白血病，流式细胞术检查可见CD13、CD33和CD117，不表达HLA-DR（E对D错）和CD34，还可表达CD9。急性B淋巴细胞白血病通常表达CD19（BC错）、CD20和CD10（C错）等。M₇（急性巨核细胞白血病）通常表达CD41（B错）。急性粒-单核细胞白血病和急性单核细胞白血病通常表达CD14（A错）。